以下哪一项心理属于健康心理
A. 抑郁情绪
B. 不愿与人交往
C. 感觉生活很乏味
D. 感觉自己很无能
E. 负性的情绪，能够积极调整

正确答案：E。负性的情绪，能够积极调整

解析：情绪在人的心理健康中起着核心的作用。心理健康者能经常保持愉快、开朗、自信的心情，善于从生活中寻求乐趣，对生活充满希望。当然，并非一个人不能有喜怒哀乐的情绪变化，而是说一旦有了负性的情绪，能够并善于从不良情绪状态中调整过来，即具有情绪的稳定性是非常重要的。掌握“心理健康概述”知识点。